下列各项，属于证临床表现的是
A. 形体肥胖，皮下多触及圆滑柔韧的包块，舌苔白腻，脉滑
B. 胸闷脘痞，呕吐清水，呕吐清稀痰涎
C. 眼睑、颜面先肿，迅速遍及全身，小便短少，咽喉肿痛
D. 下肢先肿，渐至全身，腹大痞胀，小便不利
E. 身体困重，肢体酸痛，腹胀腹泻，纳呆

正确答案：A。形体肥胖，皮下多触及圆滑柔韧的包块，舌苔白腻，脉滑

解析：证是对疾病过程中所处一定（当前）阶段的病位、病性等所作的病理性概括。是指机体对致病因素的反应状态，是对疾病当前本质所作的结论，形体肥胖，皮下多触及圆滑柔韧的包块，舌苔白腻，脉滑属于证临床表现（A对）。胸闷脘痞，呕吐清水，呕吐清稀痰涎；眼睑、颜面先肿，迅速遍及全身，小便短少，咽喉肿痛；下肢先肿，渐至全身，腹大痞胀，小便不利；身体困重，肢体酸痛，腹胀腹泻，纳呆，这些都是部分症状，不能概括出当前疾病所属证候，故不为证（BCD错）。